流脑的传染源主要是
A. 患者
B. 带菌动物
C. 带菌者
D. 急性感染者
E. 慢性感染者

正确答案：C。带菌者

解析：带菌者和流脑患者是本病的传染源，本病隐性传染率高，感染后细菌寄生于正常人鼻咽部，无症状不易被发现，且带菌者活动范围广泛，而患者经治疗后细菌很快消失，故带菌者是流脑的主要传染源（C对A错）。流脑是由脑膜炎奈瑟菌引起的急性化脓性脑膜炎，人是脑膜炎奈瑟菌唯一的天然宿主（B错），在体外易自溶而死亡。急性感染者（D错）和慢性感染者（E错）均不是流脑的主要传染源。